某男，45岁。消渴病史2年，症见头晕耳鸣、腰膝酸软、骨蒸潮热、盗汗遗精。医师处以六味地黄丸，是因其主治证是
A. 肾阴亏损
B. 精血不足
C. 气血两虚
D. 阴虚火旺
E. 肺肾阴亏

正确答案：A。肾阴亏损

解析：本题考查的是六味地黄丸的主治。消渴病史2年，症见头晕耳鸣、腰膝酸软、骨蒸潮热、盗汗遗精。医师处以六味地黄丸，是因其主治证是肾阴亏损（A对）。六味地黄丸：【主治】肾阴亏损，头晕耳鸣，腰膝酸软，骨蒸潮热，盗汗遗精，消渴。何首乌：【主治病证】（1）精血不足（B错）之头晕眼花、须发早白、腰酸脚软、遗精、崩漏、带下。（2）疮肿，瘰疬。（3）体虚久疟。（4）肠燥便秘。薯蓣丸：【主治】气血两虚（C错），脾肺不足所致的虚劳、胃脘痛、痹病、闭经、月经不调。知柏地黄丸：【主治】阴虚火旺（D错），潮热盗汗，口干咽痛，耳鸣遗精，小便短赤。麦味地黄丸：【主治】肺肾阴亏（E错），潮热盗汗，咽干咳血，眩晕耳鸣，腰膝酸软，消渴。